痛痛病患者主诉疼痛性质多为
A. 刺痛，活动时加剧
B. 刀割样痛，不缓冲
C. 间歇样痛，与气候变化无关
D. 轻度疼痛，可感受
E. 闪电样痛，伴蚁走感

正确答案：A。刺痛，活动时加剧

解析：本题考查痛痛病患者主诉疼痛性质。痛痛病是发生在日本富山县神通川流域部分镉污染地区的一种严重的环境污染性疾病，以全身剧烈疼痛为主要症状而得名，是慢性镉中毒的典型案例。其病情呈渐进性加重，发病初期腰背膝关节疼痛，随后遍及全身。疼痛的性质多为刺痛，活动时加剧（A对BCDE错），休息时缓解。